与钙代谢相似的放射性物质是
A. ⁹⁰锶
B. ¹³⁷铯
C. ⁴⁰钾
D. ¹⁴碳
E. ¹³¹碘

正确答案：A。⁹⁰锶

解析：本题考查与钙代谢相似的放射性物质。⁹⁰Sr（A对BCDE错）进入人体后大部分沉积于骨骼，其代谢与钙相似。